检查乳房部的方法，错误的是
A. 端坐，暴露乳房
B. 指腹揉按乳房
C. 手指抓捏乳房
D. 按摸乳晕观察有无溢液
E. 按压腋窝有无肿大结节

正确答案：C。手指抓捏乳房

解析：检查时光线应充足，前胸充分暴露，被检查者取坐位（A对），先两臂下垂，然后双臂高举超过头部或双手叉腰再进行检查。检查者以并拢的手指掌面略施压力，以旋转或来回滑动的方式进行触诊（B对），首先轻轻用力触摸浅表部位，再用中等力量触诊中层部分，最后用力深达胸壁进行触诊，切忌用手指将乳房提起来触摸，切勿用手指去抓捏（C错，为本题正确答案）。按外上（包括角状突出）、外下、内下、内上、中央（乳头、乳晕）各区的顺序由浅入深地进行滑动触诊，然后仔细检查腋窝、锁骨上下窝等处的淋巴结有无异常（E对）。触诊乳房时应着重注意有无红、肿、热、痛和包块。乳头有无硬结、弹性消失和分泌物（D对）。